预防动脉粥样硬化应注意多摄入
A. 饱和脂肪酸
B. 不饱和脂肪酸
C. 反式脂肪酸
D. 甘油三酯
E. 胆固醇

正确答案：B。不饱和脂肪酸